治疗鼻衄热邪犯肺证的最佳选方是
A. 银翘散
B. 沙参麦冬汤
C. 泻白散
D. 桑菊饮
E. 清燥救肺汤

正确答案：D。桑菊饮

解析：热邪犯肺证之鼻衄是由燥热伤肺，血热妄行，上溢清窍所致，治疗应该用清泄肺热，凉血止血的桑菊饮（D对）。银翘散辛凉解表，为风热犯表证之感冒的代表方（A错）。沙参麦冬汤滋阴润肺，化痰止咳，为肺阴亏损证之咳嗽的代表方（B错）。泻白散清泄肺热，止咳平喘，治疗肺热喘咳证（C错）。清燥救肺汤养阴润燥，清金降火，用于阴虚燥火内盛，干咳痰少，咽痒气逆（E错）。